属于药物经济学中所讲的直接成本的是
A. 医疗费用
B. 伤病期间造成的工资损失
C. 精神上的痛苦
D. 疾病引起的疼痛
E. 生活的不便

正确答案：A。医疗费用

解析：本题考查药物经济学的基本概念。直接成本是指用于药物治疗或其他治疗所花费的代价或资源的消耗。包括：①直接医疗费用（A对）：包括提供的药品与服务、医师的诊断和治疗、护理、检验、住院等消耗的一切费用；②非医疗费用：包括家属陪护、食宿和交通等费用。